在工农业生产中常见的化学性窒息性气体有
A. CO、CO₂
B. 甲烷、氮气
C. 水蒸气、氰化物
D. 硫化氢、甲烷
E. CO、氰化物、硫化氢

正确答案：E。CO、氰化物、硫化氢